参与炎症反应的细胞不包括
A. 嗜酸性粒细胞
B. 单核巨噬细胞
C. 中性粒细胞
D. 血管内皮细胞
E. 嗜碱性粒细胞

正确答案：A。嗜酸性粒细胞

解析：感染灶中的病原微生物及其释放的各种毒素均可刺激单核巨噬细胞（B对）、中性粒细胞（C对）、嗜碱性粒细胞（E对）、血管内皮细胞（D对）等，表达释放大量的炎症介质，引起SIRS, 促进休克的发生发展。嗜酸性粒细胞（A错，为本题正确答案）不是参与炎症反应的细胞。